慢性盘状红斑狼疮主要的好发部位是
A. 阴道黏膜
B. 食道黏膜
C. 口颊部黏膜与皮肤
D. 肛门部
E. 舌部

正确答案：C。口颊部黏膜与皮肤

解析：慢性盘状红斑狼疮主要发生于口颊部的皮肤与黏膜，多无全身性的损害。掌握“口腔扁平苔藓与慢性盘状红斑狼疮”知识点。